远志的功效有
A. 宁心安神
B. 活血化瘀
C. 祛痰开窍
D. 敛汗生津
E. 消散痈肿

正确答案：A、C、E。宁心安神；祛痰开窍；消散痈肿

解析：本题考查的是远志的功效。远志的功效有安神益智（A对）、祛痰开窍（C对）与消散痈肿（E对）。远志：【功效】安神益智，祛痰开窍，消散痈肿。血竭：【功效】活血定痛，化瘀（B错）止血，生肌敛疮。五味子：【功效】收敛固涩，益气生津，滋肾宁心。五味子能敛肺涩肠、涩精敛汗（D错），治久咳虚喘、久泻久痢、遗精滑精、虚汗不止。